前庭窗位于岬的
A. 上方
B. 下方
C. 后上方
D. 后下方
E. 无

正确答案：C。后上方

解析：岬的后上方（C对）有一卵圆形小孔，称前庭窗或卵圆窗，通向前庭。岬的后下方（D错）有一圆形小孔，称蜗窗或圆窗。